根据国家关于药品出口管理的有关规定，药品出口销售证明有效期不超过
A. 5年
B. 3年
C. 1年
D. 2年

正确答案：D。2年

解析：本题考查药品出口销售证明有效期。根据国家药品出口管理的有关规定，药品出口销售证明有效期不超过2年（D对）。药品出口销售证明有效期不超过2年，且不应超过申请资料中所有证明文件的有效期，有效期届满前应当重新申请。提供虚假证明或者采用其他手段骗取药品出口销售证明的，或知悉生产场地不符合药品GMP要求未立即报告的，注销其药品出口销售证明，且5年（A错）内不再为其出具药品出口销售证明，并将企业名称、法定代表人、社会信用代码等信息通报征信机构进行联合惩戒。